当两个强心苷苷元羟基数目相同时，水中溶解度取决于
A. 糖的种类
B. 苷元上羟基的位置
C. 是否有分子内氢键
D. 存在其他亲水性基团
E. 糖的数目

正确答案：A、B、C、D、E。糖的种类；苷元上羟基的位置；是否有分子内氢键；存在其他亲水性基团；糖的数目

解析：本题考查的是强心苷的溶解性。当两个强心苷苷元羟基数目相同时，水中溶解度取决于糖的种类（A对）、苷元上羟基的位置（B对）、是否有分子内氢键（C对）、存在其他亲水性基团（D对）与糖的数目（E对）。强心苷的溶解性：强心苷一般可溶于水、醇和丙酮等极性溶剂，微溶于乙酸乙酯、含醇三氯甲烷，难溶于乙醚、苯和石油醚等极性小的溶剂。而苷元则难溶于水等极性溶剂，易溶于乙酸乙酯、三氯甲烷等有机溶剂。强心苷的溶解性与分子中所含糖的数目、种类、苷元所含的羟基数及位置有关。（1）糖的数目：原生苷由于分子中含糖基数目多，而比其次生苷和苷元的亲水性强，可溶于水等极性大的溶剂，而难溶于极性小的溶剂。（2）羟基数目：强心苷的溶解性随其分子中糖的类型、苷元上羟基的数目不同而异。（3）羟基的位置：分子中羟基是否形成分子内氢键，也可影响强心苷的溶解性。分子中有无更多的双键、羰基、甲氧基和酯键等也能影响强心苷的溶解度。